加硝酸汞试液显砖红色的是
A. 淀粉粒
B. 糊粉粒
C. 黏液
D. 菊糖
E. 挥发油

正确答案：B。糊粉粒

解析：本题考查的是细胞内含物鉴定。加硝酸汞试液显砖红色的是糊粉粒（B对）。细胞内含物鉴定：淀粉粒（A错）：加碘试液，显蓝色或紫色；用醋酸甘油试液装片，置偏光显微镜观察，未糊化淀粉粒有偏光现象；已糊化的无偏光现象。糊粉粒：加碘试液，显棕色或黄棕色；加硝酸汞试液显砖红色。脂肪油、挥发油（E错）或树脂：加苏丹Ⅲ试液呈橘红色、红色或紫红色；加90%乙醇，脂肪油不溶解，挥发油则溶解。菊糖（D错）：加10%α-萘酚乙醇溶液，再加硫酸，呈紫红色并很快溶解。黏液（C错）：加钌红试液，显红色。